上中切牙外伤脱落，患者紧急最妥善的解决方法是
A. 直接放进牙槽窝
B. 清洗干净再放入牙槽窝
C. 自来水冲洗干净后放入水瓶内
D. 放入牛奶内
E. 冲洗擦干后放卫生纸内包裹

正确答案：B。清洗干净再放入牙槽窝

解析：本题考查牙外伤的治疗。上中切牙外伤脱落，患者紧急最妥善的解决方法是清洗干净再放入牙槽窝（B对）。完全脱位牙，如能在30min内再植，多可避免牙根吸收。因此，牙脱位后，应立即将牙放入原位，如牙已落地污染，应就地用生理盐水或无菌水冲洗，然后放入原位（A错）。如果不能即刻复位，可放在盛有牛奶、生理盐水或自来水的杯子内（CD错）。如无条件可将患牙置于患者的舌下或口腔前庭处。切忌干藏（E错），并尽快到医院就诊。